方剂的组成原则，关于佐药的说法，错误的是
A. 直接治疗兼病的药
B. 减缓君臣药毒性的药
C. 减缓君臣药烈性的药
D. 协助君臣药加强治疗作用的药
E. 与君药药性相反而又能在治疗中起相成作用的药

正确答案：A。直接治疗兼病的药

解析：本题考查的是中药的组方原则。佐药直接治疗次要兼证的药物（A错，为本题正确答案）。组方原则：每一首方剂的组成，固然必须根据病情，在辨证立法的基础上选择合适的药物，但在配伍组成时，还须遵循严格的原则。方剂组成的原则如下。（1）君药，即对处方的主证或主病起主要治疗作用的药物。它体现了处方的主攻方向，其药力居方中之首，是方剂组成中不可缺少的药物。其用量也较臣、佐药大。（2）臣药，意义有二：一是辅助君药加强治疗主病和主证的药物；二是针对兼病或兼证起治疗作用的药物。它的药力小于君药。（3）佐药，意义有三：一为佐助药，即协助君、臣药加强治疗作用，或直接治疗次要兼证的药物（D对）；二为佐制药，即用以消除或减缓君、臣药的毒性或烈性的药物（BC对）；三为反佐药，即根据病情需要，使用与君药药性相反而又能在治疗中起相成作用的药物（E对）。佐药的药力小于臣药，一般用量较轻。（4）使药，意义有二：一是引经药，即引方中诸药直达病所的药物；二是调和药，即调和诸药的作用，使其合力驱邪。使药的药力小于臣药，用量亦轻。